有关新生儿颅特征的描述，错误的是
A. 脑颅比面颅大
B. 脑、感觉器官发育早，但咀嚼、呼吸器官不发达
C. 前囟呈菱形，生后1~2岁闭合
D. 眉弓及眉间发育较快，故明显
E. 无

正确答案：D。眉弓及眉间发育较快，故明显

解析：胎儿时期由于脑及感觉器官发育早，而咀嚼和呼吸器官，尤其是鼻旁窦尚不发达（B对），因此脑颅远大于面颅（B对）。前囟在生后 1 -2 岁时闭合（C对）。新生儿额窦尚未发育，眉弓及眉间不明显（D错，为本题正确答案）。